引起产后出血的最常见原因是
A. 胎盘原因
B. 凝血功能障碍
C. 子宫收缩力过强
D. 子宫收缩乏力
E. 软产道裂伤

正确答案：D。子宫收缩乏力